下颌局部义齿舌系带处基托过长，影响舌部运动的现象解决的方案是
A. 修改卡环臂
B. 基托重衬
C. 基托缓冲
D. 重新排列人工牙
E. 修改卡环与支托，或重新制作卡环

正确答案：C。基托缓冲

解析：基托边缘伸展过长：影响唇颊舌系带及周围肌活动，也可使义齿固位不好，可将基托边缘磨短，系带处基托让开。掌握“局部义齿修复后出现的问题及处理”知识点。